下列哪项试验不是流行病学实验的特点
A. 研究对象是来自一个总体的抽样人群并随机化分组
B. 有平行可比的对照组
C. 运用危险度的分析和评价
D. 对实验组人为地施加干预措施

正确答案：C。运用危险度的分析和评价

解析：本题考查实验流行病学的特点。实验流行病学的研究对象是来自一个总体的抽象人群并随机化分组（A对），实验流行病学有平行可比的对照组（B对），实验流行病学对实验组人为地施加干预措施（D对）。运用危险度的分析和评价（C错，为本题正确答案）多用于队列研究和生态学研究，不适用于实验流行病学。